女性，28岁，足月产后5天，下腹疼痛3天，发热1天，阴道分泌物无异味，子宫增大，既往有子宫肌瘤史。本例首先考虑的诊断是
A. 产褥感染
B. 肌瘤恶性变
C. 肌瘤玻璃样变
D. 肌瘤囊性变
E. 肌瘤红色样变

正确答案：E。肌瘤红色样变

解析：该患者在产褥期（肌瘤红色样变多见于妊娠期或产褥期）出现下腹疼痛，发热，子宫增大（可有剧烈腹痛伴恶心、呕吐、发热，检查发现肌瘤迅速增大、压痛），既往有子宫肌瘤史。根据病史、临床表现及检查，首先考虑为肌瘤红色样变（E对）。产褥感染（P227）（A错）三大表现为发热、疼痛、异常恶露。肌瘤恶性变（P311）（B错）多见于绝经后伴疼痛和出血患者。肌瘤玻璃样变（P311）（C错）和囊性变（P311）（D错）无特殊临床表现，常在切除标本送病理检查后发现。